不宜用《中国药典》规定的热原检查法检查的静脉给药制剂是
A. 中药注射液
B. 中药注射用无菌粉末
C. 注射用乳剂
D. 生物制品
E. 肿瘤抑制剂

正确答案：E。肿瘤抑制剂

解析：本题考查热原与细菌内毒素的检查方法。不宜用《中国药典》规定的热原检查法检查的静脉给药制剂是肿瘤抑制剂（E对）。细菌内毒素检查：热原检查法操作烦琐，影响结果准确性的因素较多，且某些药物品种如放射性药剂、肿瘤抑制剂不宜用家兔进行热原检测，因而，鲎试验法作为体外试验法，也用于热原的检测。热原检查法：本法系将一定剂量的供试品，静脉注入家兔体内，在规定的时间内，观察家兔体温升高的情况，以判断供试品中所含热原限度是否符合规定。具体实验方法和结果判断标准见《中国药典》四部通则热原检查法。